以下微生物属于严格活细胞内寄生的原核细胞型微生物的是
A. 立克次体
B. 支原体
C. 衣原体
D. 螺旋体
E. 弯曲菌属

正确答案：A。立克次体

解析：立克次氏体是一类严格活细胞内寄生的原核细胞型微生物。掌握“立克次氏体”知识点。